下列有关社区健康教育的描述，哪一项是不正确的
A. 教育对象是社区人群
B. 要求政府采取行政措施
C. 引导居民养成良好的行为和生活方式
D. 有计划、有组织、有评价的活动
E. 是初级卫生保健的集中体现

正确答案：B。要求政府采取行政措施